在生产条件下，苯的氨基硝基化合物主要以下列哪种形式存在于空气中
A. 气溶胶
B. 粉尘或蒸气
C. 烟、雾
D. 粉尘和烟
E. 以上都不是

正确答案：B。粉尘或蒸气